在《中国药典》中，青霉素钠的含量测定方法是
A. 非水溶液滴定法
B. 紫外-可见分光光度法
C. 高效液相色谱法
D. 气相色谱法
E. 抗生素微生物检定法

正确答案：C。高效液相色谱法

解析：本题考查青霉素钠的含量测定方法。2020年版《中国药典》中，青霉素钠的含量测定方法是高效液相色谱法（C对）。